男，67岁。咳嗽、咳痰20年，加重伴气短1周。查体：T36.8℃，双肺呼吸音减弱，语音震颤减弱，叩诊呈过清音。该患者最可能的诊断是
A. 气胸
B. 心力衰竭
C. 慢性阻塞性肺疾病
D. 支气管扩张
E. 支气管哮喘

正确答案：C。慢性阻塞性肺疾病

解析：患者为老年男性，咳嗽、咳痰20年，加重伴气短1周，双肺呼吸音减弱，语颤减弱，叩诊呈过清音，考虑诊断为慢性阻塞性肺疾病（COPD）（C对）（起病缓慢，病程较长，符合COPD的典型症状）。气胸（P120）（A错）可继发于慢性阻塞性肺疾病，起病急，通常突感一侧胸痛，针刺样或刀割样，并有突然加重的呼吸困难，肺部叩诊为鼓音。心力衰竭（P166）（B错）有心肺疾病的病史，呼吸困难，咳粉红色泡沫状痰，以及体循环淤血的表现，查体肺部可闻及湿啰音，心脏扩大等体征。支气管扩张（P37）（D错）多见于儿童和青年，有咳大量浓痰和咯血症状，查体背部可闻及固定而持久的局限湿啰音。支气管哮喘（P28）（E错）多为早年发病，每日症状变化快，夜间和清晨症状明显，有过敏史、鼻炎和（或）湿疹，可有哮喘家族史，气流受限具有显著的可逆性。